女，35岁，已婚。10小时前出现上腹部胀痛，6小时前疼痛转移至右下腹，伴恶心、呕吐、发热。查体：右下腹压痛、反跳痛阳性，肠鸣音减弱。血常规：白细胞总数及中性粒细胞分类升高。最可能的诊断是
A. 急性阑尾炎
B. 胃、十二指肠溃疡穿孔
C. 急性胃肠炎
D. 急性盆腔炎
E. 急性膀胱炎

正确答案：A。急性阑尾炎